哪项不是引起咳嗽的病因
A. 刺激性气体的吸入
B. 胸膜炎
C. 左心功能不全
D. 气管异物
E. 脑膜炎

正确答案：E。脑膜炎